可用于区别胆酸和鹅去氧胆酸的反应是
A. Keller-Kiliani反应
B. 呫吨氢醇反应
C. Kedde反应
D. Hammarsten反应
E. Gregorypascoe反应

正确答案：D。Hammarsten反应

解析：本题考查的是胆汁酸的鉴别反应。可用于区别胆酸和鹅去氧胆酸的反应是Hammarsten反应（D对）。Hammarsten反应：用20%的铬酸溶液（将20g CrO₃置于少量水中，加乙酸至100ml）溶解少量样品，温热，胆酸显紫色，鹅去氧胆酸不显色。改良的Hammarsten反应是取少量样品用乙酸溶解，温热，加3～5滴浓盐酸，水浴加热至溶液浑浊并变黄色后，室温放置1～2小时，观察颜色变化，胆酸显紫色。去氧胆酸和鹅去氧胆酸无上述颜色变化。Keller-Kiliani反应（A错）与呫吨氢醇反应（B错）为α-去氧糖的颜色反应。Keller-Kiliani（K-K）反应：取样品1mg，用冰醋酸5ml溶解，加20%的三氯化铁水溶液1滴，混匀后倾斜试管，沿管壁缓慢加入浓硫酸5ml，观察界面和乙酸层的颜色变化。如有α-去氧糖，则乙酸层显蓝色。此反应是α-去氧糖的特征反应，只对游离的α-去氧糖或α-去氧糖与苷元连接的苷显色。呫吨氢醇反应：取样品少许，加呫吨氢醇试剂（呫吨氢醇10mg溶于冰醋酸100ml中，加入浓硫酸1ml）1ml，置水浴上加热3分钟，若分子中有α-去氧糖即显红色。此反应极为灵敏，分子中的α-去氧糖可定量地发生反应，故还可用于定量分析。Kedde反应（C错）为强心苷C-17位上不饱和内酯环的颜色反应。Kedde反应：又称3，5-二硝基苯甲酸试剂反应。取样品的甲醇或乙醇溶液于试管中，加入3，5-二硝基苯甲酸试剂（A液：2%的3，5-二硝基苯甲酸甲醇或乙醇溶液；B液：2mol/L氢氧化钾溶液，用前等量混合）3～4滴，溶液呈红色或紫红色。本试剂可用于强心苷纸色谱和薄层色谱显色剂，喷雾后显紫红色，几分钟后褪色。Gregory-Pascoe反应（E错）为胆汁酸的鉴别反应。Gregory-Pascoe反应：取1ml胆汁加6ml 45%硫酸及1ml 0.3%糠醛，密塞振摇后在65%水浴中放置30分钟，溶液显蓝色。该反应可用于胆酸的含量测定。